不属于多形性腺瘤中肌上皮细胞中的类型的是
A. 浆细胞样
B. 梭形样
C. 透明样
D. 树枝样
E. 上皮样

正确答案：D。树枝样

解析：本题考查多形性腺瘤。树枝样（D错，为本题正确答案）不属于多形性腺瘤中肌上皮细胞中的类型。镜下多形性腺瘤的肌上皮细胞可分为浆细胞样（A对）、梭形（B对）、透明（C对）和上皮样（E对）四种形态。